一足部患有严重溃疡的糖尿病病人，经治疗病情未减轻，且有发生败血症的危险。此时为保证病人的生命而需要对病人截肢。这里包含的冲突是
A. 有利原则与公正原则的冲突
B. 有利原则与尊重原则的冲突
C. 不伤害原则与有利原则的冲突
D. 不伤害原则与公正原则的冲突
E. 不伤害原则与尊重原则的冲突

正确答案：C。不伤害原则与有利原则的冲突

解析：在医学实践中，不伤害是指在诊治、护理过程中不使患者的身心受到损伤。有利原则又称有益原则。在医学实践中，有利原则有狭义和广义之分。狭义的有利原则是指医务人员履行对患者有利的德行，即医务人员的诊治、护理行为对患者确有助益，既能减轻痛苦或同时又能促进康复；广义的有利原则不仅对患者有利，而且医务人员的行为有利于医学事业和医学科学的发展，有利于促进人群、人类的健康和福利。然而，通常有利原则首先是指狭义的说法。由上看出，有利原则比不伤害原则的内容广泛，层次也高。掌握“医学伦理的基本原则”知识点。